有季节性升高，且人口密度大处高发的传染病，其传播途径是
A. 空气
B. 水
C. 食物
D. 接触

正确答案：A。空气

解析：本题考查经空气传播的特征。经空气（A对BCD错）传播的传染病流行特征为：①传播途径容易实现，传播广泛，发病率高；②有明显的季节性，冬春季高发；③在没有免疫预防人群中，发病呈周期性；④居住拥挤和人口密度大的地区高发。